如果进行病例对照研究，你的计划分析的指标是什么
A. 暴露组与非暴露组的发病情况
B. 病例组和对照组的暴露比例
C. 病例组和对照组的暴露情况
D. 相对危险度或比值比

正确答案：B。病例组和对照组的暴露比例

解析：本题考查病例对照研究的分析指标。在病例对照研究中，没有暴露组和非暴露组的观察人数，不能计算发病率，因此不能直接计算RR。可用比值比来描述暴露与疾病的联系强度。比值比又称比数比、优势比，为病例组与对照组两组暴露比值之比（B对ACD错）。